体内、体外均有抗凝血作用的药物是
A. 阿司匹林
B. 华法林
C. 肝素
D. 双嘧达莫
E. 噻氯匹定

正确答案：C。肝素

解析：本题考查肝素。肝素（C对）在体内、外均有抗凝作用。阿司匹林（A错）、双嘧达莫（D错）、噻氯匹定（E错）均能抑制血小板聚集，预防血栓形成。华法林（B错）通过抑制氢醌型维生素K合成产生抗凝作用，在体外无效。